下列哪些发生断裂与重接的染色体基因不丢失和增加
A. 倒位
B. 插入
C. 易位
D. 重复

正确答案：A。倒位

解析：本题考查倒位。倒位为染色体型畸变的一种类型，倒位（A对BCD错）发生断裂与重接的染色体基因不丢失和增加。